外阴硬化性苔藓临床表现不包括
A. 早期皮损颜色暗红
B. 病损区发痒
C. 大阴唇皮肤及黏膜变白
D. 肛周皮肤干燥
E. 阴蒂多萎缩

正确答案：A。早期皮损颜色暗红

解析：外阴硬化性苔藓是一种以外阴及肛周皮肤萎缩变薄、色素减退呈白色病变为主要特征的疾病。临床表现为外阴病损区瘙痒（B对）及外阴烧灼感，瘙痒程度较外阴鳞状上皮增生者轻，也有个别患者无瘙痒不适。病损区常位于大小阴唇、阴蒂包皮、阴唇后联合及肛周，多呈对称性。早期病变较轻时呈皮肤发红肿胀，出现粉红（A错，为本题正确答案）、象牙白色或有光泽的多角形小丘疹，丘疹融合成片后呈紫癜状，但在其边缘仍有散在丘疹；进一步发展则出现外阴萎缩（E对），小阴唇变小甚至消失，大阴唇变薄，皮肤颜色发白（C对）、发亮、皱缩，弹性差，常伴有皲裂及脱皮，晚期病变则出现皮肤进一步萎缩菲薄呈羊皮样改变，阴道口挛缩狭窄。